卵细胞从卵巢排出后，理想受精时间是
A. 10小时
B. 10～14小时
C. 15～18小时
D. 19～24小时
E. 24小时

正确答案：C。15～18小时

解析：本题考查理想受精时间。卵细胞从卵巢排出后15～18小时（C对ABDE错）以内受精能力最强，并能维持受精能力达30小时左右，之后卵细胞开始变性，受精能力迅速减弱并消失。